高温堆肥的卫生标准中规定堆肥温度和持续时间为
A. 人工堆温达≥50℃，至少持续10天
B. 人工堆温达≥60℃，至少持续10天
C. 机械堆温达≥50℃，至少持续5天
D. 机械堆温达≥60℃，至少持续5天
E. 机械堆温达≥55℃，至少持续5天

正确答案：A。人工堆温达≥50℃，至少持续10天

解析：本题考查高温堆肥的温度和持续时间。高温堆肥的卫生标准中规定堆肥温度和持续时间为人工堆温达≥50℃，至少持续10天（A对BCDE错）。